女，19岁。近3个月至少每周2次因情绪波动而暴饮暴食，每次摄入常人4～5倍的量，无法自控。过后又担心发胖采用催吐的方法将食物全部吐出。暴食后出现内疚自责，甚至自杀观念。体重无明显下降，该患者的诊断是
A. 躁狂发作
B. 神经性贪食
C. 神经性呕吐
D. 神经性厌食
E. 抑郁发作

正确答案：B。神经性贪食

解析：该患者因情绪波动反复暴饮暴食，每次摄入常人4－5倍的量，过后又担心发胖采用催吐的方法将食物全部吐出，体重无明显下降为神经性贪食的表现，故诊断为神经性贪食（B对）。神经性厌食者节制饮食，体重明显低于正常，与本例不符（D错）。神经性呕吐者表现为进食后自发或诱发反复呕吐，本例无此症状，故不考虑（C错）。